某学校要在教学楼内修建厕所，需要改善的是
A. 厕所设在楼的一端
B. 厕所有向外的开窗
C. 男、女厕所均按每40人设1个大便器
D. 厕所不面对教室和办公室
E. 厕所设有排气管道

正确答案：C。男、女厕所均按每40人设1个大便器